患儿1岁半。发热4天，热退后全身出现红色斑丘疹。其诊断是
A. 风疹
B. 幼儿急疹
C. 猩红热
D. 麻疹
E. 水痘

正确答案：B。幼儿急疹

解析：高热3～5天，热退疹出是幼儿急疹的典型特征（B对）。风疹为发热1～2天后出疹（A错）。猩红热为发热1～2天后出疹，出疹时高热（C错）。麻疹为发热3～4天后出疹，且出疹期间热度更高，全身症状重（D错）。水痘为低热1天后出疹（E错）。